有利于泌尿道感染治疗，不易形成结晶尿的药物是
A. 磺胺嘧啶
B. 磺胺甲噁唑
C. 磺胺多辛
D. 甲氧苄啶
E. 磺胺米隆

正确答案：B。磺胺甲噁唑